小儿3岁。身长95㎝，体重15kg，牙齿20颗，其生长发育属于
A. 体重身长均超过正常范围
B. 身体异常高大
C. 肥胖症
D. 正常范围
E. 营养不良

正确答案：D。正常范围

解析：正常3岁小儿根据公式推算身长应为91cm,14kg,20颗乳牙，小儿身长95㎝，体重15kg，牙齿20颗，身长及体重仍保持在正常值附近，属于个体差异范围（D对）（A错）。小儿身长95㎝，正常平均身长为91cm，不属于异常高大，且描述不具备概括性（B错）。小儿体重15kg，正常平均身高为14kg，仍然属于正常范围（C错）。小儿身长95㎝，体重15kg，牙齿20颗，发育良好（E错）。